能体现人体实验知情同意原则的是
A. 以健康人或病人作为人体实验的受试对象
B. 人体试验时都需要使用对照和双盲法
C. 人体实验都需要伦理委员会审查
D. 参与人体实验的受试者只有得到专家的允许后，中途才可以退出实验
E. 脆弱人群若参加人体实验，需要监护人的签字同意

正确答案：E。脆弱人群若参加人体实验，需要监护人的签字同意

解析：人体实验必须经过受试者知情同意，知情同意是人体实验进行的前提。缺乏或丧失知情同意能力的脆弱人群若参加人体实验，需要监护人的签字同意（E对），体现人体实验知情同意的伦理原则。未取得知情同意而以健康人或病人作为受试对象（A错），不能体现人体实验知情同意的伦理原则。实验时使用对照和双盲法（B错）体现的是人体实验必须遵守严谨的学风，属于人体实验的基本伦理准则。人体实验都需要伦理委员会审查（C错），不能体现受试者的参加人体实验知情同意的伦理原则。正在参加人体实验的受试者，尽管他已经知情同意，但仍享有不需要陈述任何理由而随时退出人体实验的权利（D错）。